在可摘局部义齿中，减少义齿（牙合）力的方法，不包括
A. 减小人工牙的颊舌径
B. 降低牙尖斜度
C. 选用塑料
D. 减少人工牙的咬合接触
E. 在游离端义齿修复中可减少人工牙数目

正确答案：D。减少人工牙的咬合接触

解析：本题考查减少义齿（牙合）力的方法。恢复缺牙咀嚼功能是义齿修复的主要目的，而减少人工牙的咬合接触（D错，为本题的正确答案）就失去了修复的意义。恢复缺牙咀嚼功能是义齿修复的主要目的。可摘局部义齿所受牙合力在组织的耐受阈以内时，是一种生理功能性刺激，若过大，则会造成牙周创伤、加速牙槽嵴的吸收。义齿的咀嚼承受力应根据基牙情况、咬合关系恢复到一个合适的程度。在可摘局部义齿中，减少义齿（牙合）力的方法包括：①选用塑料牙（C对），塑料牙自身的机械性能和硬度较对颌的天然正常牙为差，可以减少义齿所承受的咬合力；②减小人工牙的颊舌径（A对）、近远中径，减少人工牙的咬合接触面积以减低所受（牙合）力；③在游离端义齿修复中可减少人工牙数目（E对）；④降低牙尖斜度（B对），以减少侧向分力。